男，30岁，四肢、躯干重度烧伤，6天后高热、谵妄，周身皮疹，创面有较多黄稠脓性分泌物。对该病人高热原因的进一步确诊，应采用的可靠方法是
A. 胸部X线摄片
B. 抽血作厌氧菌培养
C. 抽血作真菌检查和培养
D. 抽血作普通细菌培养
E. 骨髓细菌培养

正确答案：C。抽血作真菌检查和培养

解析：病人之前全身应用大量抗生素，所以为判断病因应该抽血进行真菌的检查和培养。掌握“外科感染”知识点。